对靶细胞在分子水平上有识别能力的主动靶向制剂是
A. 免疫脂质体
B. 前体药物制剂
C. 长循环脂质体
D. 微囊
E. 磁性微球

正确答案：A。免疫脂质体

解析：本题考查的是靶向制剂的分类。对靶细胞在分子水平上有识别能力的主动靶向制剂是免疫脂质体（A对）。免疫脂质体，即在脂质体表面接上某种抗体，具有对靶细胞分子水平上的识别能力，可提高脂质体的靶向性。按照靶向作用方式，靶向制剂可分为：1）被动靶向制剂，即自然靶向制剂。常见的有微囊（D错）、微球和脂质体。2）主动靶向制剂，包括前体药物（B错）和经过修饰的药物载体两大类。修饰的药物载体主要有：①修饰的脂质体：如长循环脂质体（C错）、免疫脂质体、糖基修饰的脂质体；②修饰的微球；③其他，如修饰的微乳、修饰的纳米球等。3）物理化学靶向制剂，主要有：①磁性制剂，如磁性微球（E错）、磁性纳米囊；②栓塞靶向制剂；③热敏靶向制剂；④pH敏感靶向制剂。